患者，男,80岁，排便困难3年，大便艰涩，腹痛拘急，胀满拒按，胁下偏痛，手足不温，呃逆呕吐，舌苔白腻，脉弦紧，治疗应首选的方剂是
A. 济川煎
B. 黄芪汤
C. 补中益气汤
D. 大黄附子汤
E. 青麟丸

正确答案：D。大黄附子汤

解析：便秘分实秘、虚秘。实秘有热秘、气秘、冷秘。虚秘有气虚秘、血虚秘、阴虚秘、阳虚秘。患者大便艰涩，腹痛拘急，胀满拒按，判断为实证；手足不温，呃逆呕吐，舌苔白腻，脉弦紧，判断为寒证，证情属寒属实为冷秘，用大黄附子汤加减（D对）。济川煎治阳虚秘（A错）；黄芪汤治气虚秘（B错）；补中益气汤，补气升阳，治气虚下陷（C错）；青麟丸治热秘（E错）。